患者，女，62岁。左耳后肿块溃破年余，只流血水，其味臭秽，疮口凹凸不平，肿硬如岩石，形体消瘦，面色无华，唇舌淡红，脉细无力。治疗应首选
A. 和营散坚丸
B. 开郁散
C. 八珍汤合四妙汤
D. 归脾汤
E. 八珍汤

正确答案：C。八珍汤合四妙汤

解析：该题患者左耳后肿块溃破年余，形体消瘦，面色无华符合失荣的特点。患者肿块溃后破烂流血，外耗于卫，内夺于荣，气血耗损，终成败症，故见只流血水，其味臭秽，疮口凹凸不平，肿硬如岩石，形体消瘦，面色无华。舌脉亦为后期气血两亏的征象。治宜调补气血，方用香贝养荣汤（C对）。和营散坚丸功能益气养荣、疏肝散结，用于失荣之中期（A错）。开郁散功能解郁化痰、活血散结，用于失荣之早期（B错）。归脾汤功能健脾养心安神，用于乳衄之脾虚失统（D错）。八珍汤功能补气养血，但在此题中缺解毒化瘀之功，可用于乳岩之正虚毒盛证（E错）。